药材常见的变质现象有
A. 虫蛀
B. 霉变
C. 变色
D. 走油
E. 风化

正确答案：A、B、C、D、E。虫蛀；霉变；变色；走油；风化

解析：本题考查的是中药贮藏中常发生的变质现象。药材常见的变质现象有虫蛀（A对）、霉变（B对）、变色（C对）、走油（D对）、风化（E对）。中药贮藏中常发生的变质现象包括虫蛀、霉变、变色、走油、风化、自燃、其他。